以人体作为观察对象，以临床为研究场所，对口腔诊断技术、口腔治疗方法和口腔预防措施的效果进行评价的研究方法是
A. 横断面研究
B. 组群研究
C. 临床试验
D. 病例对照研究
E. 纵向研究

正确答案：C。临床试验

解析：临床试验是指以人体作为观察对象，以临床为研究场所，对口腔诊断技术、口腔治疗方法和口腔预防措施的效果进行评价的研究方法。掌握“口腔临床试验方法”知识点。